患者，男，68岁。患消渴病20余年，现多食、多饮诸症不明显，唯小便频数，饮一溲一，面色黧黑，腰膝痠软，形寒怕冷，舌淡苔白，脉沉无力。治疗应首选
A. 消渴方
B. 玉女煎
C. 左归饮
D. 金匮肾气丸
E. 六味地黄丸

正确答案：D。金匮肾气丸

解析：本病例以肾虚为主、多尿症状较为突出，属下消；下元虚衰，约束无权，而导致小便频数，饮一溲一；水谷之精微随尿液下注，无以熏肤充身，残留浊阴，未能排出，故面色黧黑；腰为肾之府，肾虚故腰膝痠软；命门火衰，无以温煦机体，故形寒怕冷；舌淡苔白，脉沉无力，俱为阴阳俱虚之象，故诊断为阴阳两虚证，治以滋阴温阳，补肾固涩，代表方为金匮肾气丸（D对）。消渴方，其功用为清热降火，可用于上消、肺热津伤证（A错）。玉女煎，其功用为清胃滋阴，可用于中消、胃热炽盛证(B错)。左归饮，其功用为补益肾阴，补力较峻，用于肾阴不足证（C错）。六味地黄丸，其功用为滋补肝肾，可用于下消、肾阴亏虚证（E错）。